华特片用于协助诊断
A. 髁突骨瘤
B. 下颌骨肿瘤
C. 下颌骨颏孔
D. 颞下颌关节
E. 牙源性上颌窦炎

正确答案：E。牙源性上颌窦炎

解析：本题考查口外片。华特片用于协助诊断牙源性上颌窦炎（E对）。华特位片在上颌骨肿瘤、炎症及颌面部外伤时，常用此片检查。怀疑牙源性上颌窦炎时，可用此片协助诊断。